患儿，女，2岁。形体消痩，面色少华，纳差，大便溏，每日2～3次，舌淡苔少。查体：体重9Kg，皮肤黏膜苍白，心、肺（-），腹壁皮下脂肪0.45cm。诊断为营养不良，其程度及证型是
A. Ⅰ度，疳气
B. Ⅱ度，疳气
C. Ⅰ度，疳积
D. Ⅱ度，疳积
E. Ⅲ度，干疳

正确答案：B。Ⅱ度，疳气

解析：本病已明确诊断为营养不良，即“蛋白质-能量营养不良”病，此属于中医“疳证”范畴。根据病情轻重、病程长短及病机虚实，疳证可具体分为疳气、疳积和干疳：其中，疳气以形体略瘦，面色少华，食欲不振，性情急躁为主要临床特征；疳积以形体消痩，肚腹胀大，面黄发疏为主要临床特征（CD错）；干疳以形体极度消痩，精神萎靡，杳不思食为主要临床特征（E错）。同时，依据体重的降低程度可以判断病情程度：体重低于同年龄、同性别参照人群值的均数减2个标准差，为轻度；体重低于同年龄、同性别参照人群值的均数减2～3个标准差，为中度；体重低于同年龄、同性别参照人群值的均数减3个标准差，为重度。根据该患儿以形体消痩，面色少华纳差，大便溏为临床主症，可辨为"疳气"；2岁女童的平均体重为11.92kg，标准差约为1.2，该患儿体重为9kg，比同年龄、同性别参照人群值的体重均数低了2.92kg，即低于同年龄、同性别参照人群值的均数减2～3个标准差，故为中度。因此，其营养不良的程度及证型是Ⅱ度，疳气（B对）。